治疗肾性贫血应及早选用的药物是
A. 叶酸
B. 维生素B12
C. 糖皮质激素
D. 铁剂
E. 促红细胞生成素

正确答案：E。促红细胞生成素

解析：肾性贫血主要是由于肾组织分泌促红细胞生成素（EPO）减少所致，故应及早选用促红细胞生成素（E对）。巨幼细胞贫血补充叶酸（A错）或维生素B12（B错），溶血性贫血采用糖皮质激素（C错）或脾切除术，缺铁性贫血补铁（D错）及治疗导致缺铁的原发病。